病势较缓，尚可忍耐，但绵绵不休的症状，称为
A. 空痛
B. 酸痛
C. 胀痛
D. 重痛
E. 隐痛

正确答案：E。隐痛

解析：本题考查疼痛的性质。病势较缓，尚可忍耐，但绵绵不休的症状是隐痛，多因阳气精血亏虚，脏腑经脉失养所致。常见于头、胸、脘、腹等部位（E对）。空痛指疼痛兼有空虚感的症状（A错）。酸痛指疼痛兼有酸软感的症状（B错）。胀痛指疼痛兼有胀感的症状（C错）。重痛指疼痛兼有沉重感的症状（D错）。